10岁以下儿童肠息肉最常见的类型是
A. 错构瘤性息肉
B. 管状腺瘤性息肉
C. 绒毛状腺瘤性息肉
D. 炎性息肉
E. 化生性息肉

正确答案：A。错构瘤性息肉

解析：肠息肉是一类从黏膜表面突出到肠腔内的隆起状病变的临床诊断，病理上可分为四类：①腺瘤性息肉：包括管状腺瘤、绒毛状腺瘤及管状绒毛状腺瘤；②炎性息肉：包括黏膜炎性增生息肉、血吸虫卵性息肉和良性淋巴样息肉；③错构瘤性：幼年性息肉和色素沉着息肉综合征；④其他：化生性息肉和黏膜肥大赘生物。10岁以下儿童肠息肉最常见的类型是错构瘤性息肉（A对）。